根据《处方管理办法》，处方前记应该标明的是
A. 药品金额
B. 临床诊断
C. 药品名称
D. 药品性状
E. 用法用量

正确答案：B。临床诊断

解析：本题考查的是处方内容。根据《处方管理办法》，处方前记应该标明的是临床诊断（B对）。处方内容：按照卫生部统一规定的处方标准，处方由前记、正文和后记三部分组成。（1）前记：包括医疗机构名称、患者姓名、性别、年龄、门诊或住院病历号，科别或病区和床位号、临床诊断、开具日期等，可添列特殊要求的项目。麻醉药品和第一类精神药品处方还应当包括患者身份证明编号，代办人姓名、身份证明编号。（2）正文：以Rp或R（拉丁文Recipe“请取”的缩写）标示，分列药品名称（C错）、剂型、规格、数量、用法用量（E错）。此部分是处方的核心内容，直接关系到患者用药的安全有效。（3）后记：医师签名或者加盖专用签章，药品金额（A错）以及审核、调配，核对、发药药师签名或者加盖专用签章。